属于I型超敏反应的疾病是
A. 肾小球肾炎
B. 风湿病
C. 过敏性休克
D. 免疫性溶血性贫血
E. 接触性皮炎

正确答案：C。过敏性休克

解析：临床常见的I型超敏反应性疾病：①药物过敏性休克；②呼吸道过敏反应；③消化道过敏反应；④皮肤过敏反应。掌握“概述及Ⅰ型超敏反应”知识点。